下列关于义齿初戴情况的检查及处理方法说法不正确的是
A. 如有早接触点，应调磨到人工牙和天然牙都有均匀接触
B. 如个别牙无（牙合）接触或咬合低，可用自凝塑料恢复咬合
C. 边缘过长可导致咬合时疼痛，应做适当修改
D. 支托如有移位，必须重新制作
E. 连接杆与黏膜接触过紧，则压迫黏膜产生压痛

正确答案：D。支托如有移位，必须重新制作

解析：卡环和支托应做到支托与支托凹密合，卡环与牙面密合，若卡环在基牙上的位置不合适，可用技工钳加以调整；支托如有移位，可从塑料内取出加以调整，用自凝塑料固定。咬合关系先检查正中（牙合）后检查非正中（牙合），如有早接触点，应调磨到人工牙和天然牙都有均匀接触；如个别牙无（牙合）接触或咬合低，可用自凝塑料恢复咬合。连接杆与黏膜接触的紧密程度如两者之间有较大的间隙，可能造成食物嵌塞，唾液滞留引起不适；如接触过紧，则压迫黏膜产生压痛。边缘过长、组织面于下颌隆突区缓冲不够，咬合有早接触点使力集中在某一点，均可导致咬合时疼痛，都应分别找出原因，并做适当修改。掌握“局部义齿的初戴”知识点。